男性，40岁。患牙有自发剧痛2天。松动I°，叩诊（+）。近中颊侧牙周袋7mm，温度刺激试验有激发痛，患牙应急处理后最佳治疗方案是
A. 牙周治疗
B. 牙髓治疗
C. 拔除
D. 牙周牙髓联合治疗
E. 根管治疗

正确答案：D。牙周牙髓联合治疗

解析：本题考查逆行性牙髓炎的治疗。由于深牙周袋内的细菌、毒素通过根尖孔或近根尖处的根管侧支进入牙髓，先引起近根尖处的牙髓充血和发炎，以后局限的慢性牙髓炎可急性发作，表现为剧烈的自发痛等典型的急性牙髓炎症状，临床检查时可见患牙有深达根尖区的牙周袋且伴有牙齿松动，牙髓有明显的激发痛，患者有自发剧痛2天，且有深牙周袋，有激发痛，患者的症状符合逆行性牙髓炎的特征。逆行性牙髓炎是牙周-牙髓联合病变的一型，只进行牙周治疗（A错）并不能使牙髓病变恢复，只进行牙髓治疗（B错）、根管治疗（E错）也不能使牙周病变恢复，应在做牙髓治疗的同时积极进行牙周炎的系列治疗，即牙周牙髓联合治疗（D对）。对于牙周病及牙髓病的处理应坚持尽量保存患牙的原则，在有其他治疗方法可供选择的情况下应尽量避免拔除（C错）患牙。